姜炙法炮制药物时，每100kg净药材，用生姜
A. 5kg
B. 10kg
C. 15kg
D. 20kg
E. 25kg

正确答案：B。10kg

解析：本题考查的是姜炙的操作方法。姜炙法炮制药物时，每100kg净药材，用生姜10kg（B对）。姜炙的操作方法：将药物与定量的姜汁拌匀，放置闷润，使姜汁逐渐渗入药物内部。然后置炒制容器内，用文火炒至规定程度，取出晾凉。或者将药物与姜汁拌匀，待姜汁被吸尽后，进行干燥。姜汤煮：将鲜姜切片煎汤，加入药物煮2小时，待姜汁基本被吸尽，取出，切片，干燥。生姜的用量一般为每100kg药物，用生姜10kg。若无生姜，可用干姜煎汁，用量为生姜的三分之一。5kg（A错）为醋制乳香时，每100kg乳香用米醋的量。醋乳香：取净乳香，置炒制容器内，用文火加热，炒至冒烟，表面微熔，喷淋定量的米醋，边喷边炒至表面油亮光泽时，迅速取出，摊开放凉。每100kg乳香，用米醋5kg。15kg（C错）为醋制大黄时，每100kg大黄用米醋的量。醋大黄：取大黄片或块，用米醋拌匀，稍闷润，待醋被吸尽后，置炒制容器内，用文火加热，炒干，取出，晾凉，筛去碎屑。每100kg大黄片或块，用米醋15kg。20kg（D错）为油炙淫羊藿时，每100kg淫羊藿用羊脂油的量。炙淫羊藿：取羊脂油置锅内加热熔化，加入淫羊藿丝，用文火加热，炒至油脂吸尽，表面呈油亮光泽时，取出，晾凉。每100kg淫羊藿，用羊脂油（炼油）20kg。25kg（E错）为蜜炙法中，每100kg药物用熟蜜的量。蜜炙法中熟蜜的用量视药物的性质而定。一般质地疏松、纤维多的药物用蜜量宜大；质地坚实，黏性较强，油分较多的药物用蜜量宜小。通常为每100kg药物，用熟蜜25kg。